某地进行首次糖尿病普查，可得出
A. 糖尿病发病率
B. 糖尿病罹患率
C. 糖尿病患病率
D. 糖尿病续发率
E. 糖尿病死亡率

正确答案：C。糖尿病患病率